支气管肺癌病人，近年来出现头面部、颈部和上肢水肿。查体可见颈静脉怒张，其发生是由于
A. 上腔静脉阻塞
B. 下腔静脉阻塞
C. 癌转移致心包积液
D. 癌转移致胸腔大量积液
E. 以上均有可能

正确答案：A。上腔静脉阻塞

解析：支气管肺癌晚期可压迫或阻塞上腔静脉，引起上腔静脉回流受阻，出现头面部、颈部和上肢静脉怒张、皮下水肿（A对）。下腔静脉阻塞（B错）多由于下腔静脉的血栓形成、炎症或内脏肿瘤的压迫引起，表现为腹壁、脐以下血管曲张，下肢水肿、溃疡，一般不见于肺癌患者。心包积液（C错）主要表现为呼吸困难、血压降低、颈静脉怒张，肺癌患者极少发生心包转移。胸腔大量积液（D错）多由于周围型肺癌侵犯胸膜所致，支气管肺癌少见，主要表现为呼吸困难、纵隔向健侧移位，胸部叩诊呈浊音。